临床常用的牙本质表面处理剂是
A. 30%磷酸
B. 30%枸橼酸
C. 30%聚丙烯酸
D. 0.5mol/L EDTA
E. 30%马来酸

正确答案：D。0.5mol/L EDTA

解析：本题考查临床常用的牙本质表面处理剂。临床常用的牙本质表面处理剂是0.5mol/L EDTA（D对）。牙体预备时，由于切割和挤压，牙本质表面形成玷污层，由无机物碎屑和凝固的胶原纤维，堵塞牙本质小管，降低了牙本质的通透性，不利于牙本质的粘接，因此需要表面处理，处理玷污层，提高表面能及增加表面积。